左归丸的功能
A. 滋肾补阴
B. 滋阴降火
C. 补肾益精
D. 补养气血

正确答案：A。滋肾补阴

解析：本题考查左归丸的功能。左归丸的功能滋肾补阴（A对）。左归丸【功能】滋肾补阴。大补阴丸【功能】滋阴降火（B错）。五子衍宗丸（片、口服液）【功能】补肾益精（C错）。当归补血口服液（丸、胶囊）【功能】补养气血（D错）。杞菊地黄丸（片、浓缩丸、口服液、胶囊）【功能】滋肾养肝（E错）。